女性，32岁。主诉刷牙时常出血，检查发现牙龈肿胀、松动，皮肤有出血、瘀斑。缺乏的维生素在下列食物中含量最丰富的是
A. 动物内脏
B. 蔬菜
C. 粮谷类
D. 蛋类
E. 豆类

正确答案：B。蔬菜